男，50岁。反复咳嗽、咳痰5年余，咳白色黏痰，晨起明显，受凉后加重，秋冬季症状明显。本次加重3天。吸烟史10余年，约20支/日，饮酒史20余年，其支气管黏膜活检最主要的炎症细胞是
A. 嗜酸性粒细胞
B. 淋巴细胞
C. 中性粒细胞
D. 巨噬细胞
E. 肥大细胞

正确答案：C。中性粒细胞

解析：老年男性患者，常年吸烟史，反复咳嗽、咳痰，咳白色黏痰，晨起明显，受凉后加重，考虑为COPD。COPD是以气道、肺实质和肺血管的慢性炎症为特征性改变的疾病，中性粒细胞、巨噬细胞（D错）、T淋巴细胞（B错）等炎症细胞均参与了慢阻肺的发病过程，其中中性粒细胞（C对）的活化和聚集是慢阻肺炎症过程的一个重要环节，因此支气管黏膜活检时最主要的炎症细胞是中性粒细胞（C对）。肥大细胞（E错）为哮喘等过敏反应性疾病主要的炎症细胞。